在脊髓外侧索内下行的纤维束是
A. 脊髓小脑束
B. 脊髓丘脑束
C. 皮质脊髓侧束
D. 薄束
E. 内侧纵束

正确答案：C。皮质脊髓侧束

解析：脊髓小脑束（A错）在脊髓外侧索内上行。脊髓丘脑束（B错）在脊髓外侧索和前索内上行。皮质脊髓侧束（C对）在脊髓外侧索内下行。薄束（D错）在脊髓后索内上行。内侧纵束（E错）位于脊髓前索。